不是细菌侵袭性酶的是
A. 血浆凝固酶
B. 透明质酸酶
C. 链激酶（SK）
D. 链道酶（SD）
E. 溶菌酶

正确答案：E。溶菌酶

解析：具有侵袭力的细菌胞外酶有：血浆凝固酶、透明质酸酶、链激酶、DNA酶。链道酶为乙型溶血性链球菌产生的一种侵袭性酶，又称链球菌DNA酶。掌握“医院感染及细菌的致病性”知识点。